以下药物中作为根管倒充填材料时渗透最小，根尖封闭性显著优于其他封闭剂的是
A. 氢氧化钙
B. 树脂类
C. 氧化锌丁香油类
D. 玻璃离子类
E. 硅酮类

正确答案：D。玻璃离子类

解析：玻璃离子类当作为根管倒充填材料时渗透最小，根尖封闭性显著优于其他封闭剂。掌握“根管充填”知识点。